急性脑病综合征常见于
A. 精神分裂症
B. 抑郁症
C. 精神发育迟滞
D. 监护病房中的垂危病人
E. 心身疾病

正确答案：D。监护病房中的垂危病人

解析：急性脑综合征又称谵妄（P55）是一组表现为急性、一过性、广泛性的认知障碍，尤以意识障碍为主要特征。起病急、病程短暂、病情发展迅速，常见于住院患者，特别是老年病房、急诊室和重症监护病房中（D对）。